黄连上清丸的功能是
A. 泻火通便，清肝明目
B. 清热解毒，利水消肿
C. 清热通便，散风止痛
D. 清热解毒，泻火通便
E. 清热燥湿，泻火解毒

正确答案：C。清热通便，散风止痛

解析：本题考查的是黄连上清丸的功能。黄连上清丸的功能是清热通便，散风止痛（C对）。黄连上清丸：【功能】散风清热，泻火止痛。决明子：【功效】清肝明目，润肠通便（A错）。半边莲：【功效】清热解毒，利水消肿（B错）。牛黄至宝丸：【功能】清热解毒，泻火通便（D错）。黄芩：【功效】清热燥湿，泻火解毒（E错），止血，安胎。